实验室病原学诊断方法不包括
A. 镜下直接观察
B. 病原菌分离、培养和鉴定
C. 病原菌的抗原检测
D. 病原菌的核酸检测
E. 血清学诊断

正确答案：E。血清学诊断

解析：实验室病原学诊断分为四类：镜下直接观察；病原菌分离、培养和鉴定；病原菌的抗原检测；病原菌核酸的检测。而血清学诊断不属于实验室病原学诊断方法。掌握“细菌学、血清学诊断及感染防治”知识点。